制订住宅小气候标准应以何季度为主
A. 冬春季
B. 春秋季
C. 冬夏季
D. 夏秋季
E. 秋冬季

正确答案：C。冬夏季

解析：本题考查制订住宅小气候的标准。由于冬夏两季室内外温差较大，因此制订住宅小气候标准应以冬夏两季（C对ABDE错）为主。